肝癌一般不转移至
A. 淋巴结
B. 脾
C. 腹膜
D. 肺
E. 脑

正确答案：B。脾